可抑制碳酸酐酶、抑制H⁺-Na⁺交换的药物
A. 呋喃苯胺酸
B. 乙酰唑胺
C. 安体舒通
D. 氨苯蝶啶
E. 甘露醇

正确答案：B。乙酰唑胺

解析：本题考查利尿药的作用机制。可抑制碳酸酐酶、抑制H⁺-Na⁺交换的药物是乙酰唑胺（B对）。乙酰唑胺通过抑制碳酸酐酶的活性而抑制HCO₃⁻的重吸收，治疗量时乙酰唑胺抑制近曲小管约85%的HCO₃⁻的重吸收。由于Na⁺在近曲小管可与HCO₃⁻结合排出，集合管Na⁺重吸收会大大增加，使K⁺的分泌相应增多（Na⁺-K⁺交换增多）。呋喃苯胺酸（A错）又名呋塞米，为高效利尿药，主要作用部位在髓袢升支粗段，干扰Na⁺-K⁺-2Cl⁻共同转运系统，产生强大的利尿作用。安体舒通（C错）又名螺内酯，为保钾利尿药，是全固态弄的竞争性拮抗药，可竞争性地与胞浆中的醛固酮受体结合而拮抗醛固酮的排钠保钾作用，促进Na⁺和水的排出，减少K⁺排出。氨苯蝶啶（D错）为保钾利尿药，主要作用于远曲小管末端和集合管，通过阻滞管腔膜Na⁺通道而减少Na⁺的重吸收，同时由于Na⁺的重吸收减少使管腔的负电位降低，导致驱动K⁺分泌的动力减少，抑制了K⁺分泌，因而产生排Na⁺、利尿、保K⁺的作用。甘露醇（E错）为脱水药，利尿作用机制分两个方面：①甘露醇增加血容量，并促进前列腺素I₂分泌，从而扩张肾血管，增加肾血流量（包括肾髓质血流量）。②本药自肾小球滤过后极少（＜10%）由肾小管重吸收，故可提高肾小管内液渗透浓度，减少肾小管对水及Na⁺、Cl⁻、 K⁺、Mg²⁺、Ca²⁺、HCO₃⁻和磷盐等电解质的重吸收。